关于釉质龋病理变化的叙述，不正确的是
A. 由表层至深层可分为透明层、脱矿层、病损体部、表层
B. 树胶或喹啉浸渍暗层可表现为暗黑色
C. 窝沟龋通常可形成口小底大的潜行性龋
D. 表层中有抗酸力强的特性
E. 病损体部脱矿最严重

正确答案：A。由表层至深层可分为透明层、脱矿层、病损体部、表层

解析：本题考查牙釉质龋。关于釉质龋病理变化的叙述，不正确的是由表层至深层可分为透明层、脱矿层、病损体部、表层（A错，为本题正确答案）。结合透射光显微镜、偏光显微镜、显微放射摄影观察早期平滑面釉质龋纵断磨片，由深层至表层病变可分为四层，即透明层、暗层、病损体部、表层。